咳嗽伴有杵状指(趾)主要见于
A. 上呼吸道感染
B. 胸膜炎
C. 喉头水肿
D. 支气管扩张
E. 肺结核

正确答案：D。支气管扩张

解析：咳嗽伴有杵状指(趾)主要见于支气管扩张（D对），杵状指（趾）多因组织缺氧、代谢障碍及中毒造成指端组织增生所致，常见于呼吸系统疾病、某些心血管疾病以及营养障碍性疾病。上呼吸道感染（P13）（A错）主要表现为发热、咳嗽、喷嚏、咽痛等。胸膜炎（B错）主要表现为胸痛、胸闷、咳嗽、气急、呼吸困难等。喉头水肿（C错）主要表现为喉痛、声嘶、喉喘鸣和呼吸困难等。肺结核（P64）（E错）主要表现为咳嗽、咳痰、痰中带血或咯血、乏力、低热、盗汗等。